脑膜炎奈瑟球菌
A. 无鞭毛，大多数有荚膜和菌毛
B. 无菌毛和鞭毛，大多数有荚膜
C. 有鞭毛，大多数有荚膜或菌毛
D. 无菌毛或鞭毛，大多数有荚膜
E. 无鞭毛和荚膜，大多数有菌毛

正确答案：A。无鞭毛，大多数有荚膜和菌毛

解析：脑膜炎奈瑟球菌：革兰氏阴性球菌，直径0.6～0.8μm，呈肾形成双排列，不形成芽胞，无鞭毛，大多数有荚膜和菌毛。营养要求较高，需用营养培养基——血琼脂（巧克力色）培养基才能培养，初次分离培养尚需5%～10%二氧化碳（CO2）气体环境。对外界抵抗力弱。掌握“肠球菌属及奈瑟菌属”知识点。